雄黄中毒的主要临床表现为
A. 口舌、四肢及全身麻木，头痛，头晕、精神恍惚、牙关紧闭
B. 头晕、头痛、烦躁不安、面部肌肉紧张、吞咽困难，伸肌与肌同时收缩
C. 咽喉干痛、烧灼感，口中金属味、流涎、腹痛腹泻，出现各种出血症状，黄疸
D. 胸闷，心悸，心律不齐，四肢厥冷，血压下降，心电图显示房室传导阻滞
E. 严重脱水，低蛋白血症，水肿，精神错乱，幻觉，癫痫样发作

正确答案：C。咽喉干痛、烧灼感，口中金属味、流涎、腹痛腹泻，出现各种出血症状，黄疸

解析：本题考查的是雄黄及含雄黄的中成药的中毒表现。雄黄中毒的主要临床表现为咽喉干痛、烧灼感，口中金属味、流涎、腹痛腹泻，出现各种出血症状，黄疸（C对）。雄黄及含雄黄的中成药的中毒表现：1.消化系统表现为口腔咽喉干痛、烧灼感，口中有金属味，流涎，剧烈恶心呕吐、腹痛腹泻，严重时类似霍乱。2.各种出血症状，如吐血、咯血、眼结膜充血、鼻衄、便血、尿血等。3.肝肾功能损害而引起转氨酶升高、黄疸、血尿、蛋白尿等。4.严重者因心力衰竭、呼吸衰竭而死亡。5.长期接触可引起皮肤过敏，出现丘疹、疱疹、痤疮样皮疹等。口舌、四肢及全身麻木，头疼、头晕、精神恍惚、牙关紧闭（A错）为乌头类药物的中毒表现。乌头类药物的中毒表现：1.神经系统：表现为口舌、四肢及全身麻木，头痛，头晕，精神恍惚，语言不清或小便失禁，继而四肢抽搐、牙关紧闭、呼吸衰竭等。2.循环系统：表现为心悸气短、心律失常、血压下降、面色苍白、口唇发绀、四肢厥冷等。3.消化系统：表现为流涎、恶心、呕吐、腹痛、腹泻、肠鸣音亢进。头晕、头痛、烦躁不安、面部肌肉紧张、吞咽困难，伸肌与肌同时收缩（B错）为马钱子及含马钱子的中成药的中毒表现。马钱子的中毒表现：初期出现头晕、头痛、烦躁不安、面部肌肉紧张、吞咽困难；进而伸肌与屈肌同时做极度收缩，发生典型的士的宁惊厥、痉挛，甚至角弓反张，可因呼吸肌痉挛窒息或心力衰竭而死亡。胸闷，心悸，心律不齐，四肢厥冷，血压下降，心电图显示房室传导阻滞（D错）为蟾酥及含蟾酥的中成药的中毒表现。蟾酥及含蟾酥的中成药的中毒表现：1.循环系统：表现为胸闷、心律失常、脉缓慢无力、心电图显示房室传导阻滞等。严重时面色苍白、口唇发绀、四肢厥冷、大汗虚脱、血压下降、休克，甚至心搏骤停而死亡。2.消化系统：表现为恶心呕吐、腹痛、腹泻等。严重脱水，低蛋白血症，水肿，精神错乱，幻觉，癫痫样发作（E错）为蓖麻子的不良反应表现。蓖麻子的不良反应表现：蓖麻毒素经呼吸道吸入、消化道摄入和肌内注射均可致人中毒，潜伏期一般为4～8小时，临床主要表现如下。①消化系统：口麻、咽部烧灼感、恶心、呕吐、腹痛、腹泻、出血性胃肠炎，黄疸以及中毒性肝病等。②呼吸、循环系统：呼吸、循环衰竭。③网状内皮系统：严重脱水、低蛋白血症、水肿、毒血症、高热。④血液、泌尿系统：溶血；血便、血尿、少尿、尿闭等中毒性肾病。⑤神经系统：四肢麻木、步态不稳、烦躁不安、精神错乱、手舞足蹈、昏迷、幻觉、癫痫样发作。⑥有时可伴发过敏反应如口唇青紫、荨麻疹。